军团菌对生长条件有特殊要求，生长时需要
A. L-半胱氨酸和铁盐
B. L-半胱氨酸和铝盐
C. 赖氨酸和铁盐
D. 赖氨酸和铝盐
E. α-酮戊二酸

正确答案：A。L-半胱氨酸和铁盐

解析：本题考查军团菌对生长条件的要求。军团菌为需氧革兰阴性杆菌，是一种人类单核细胞和巨噬细胞内寄生菌。军团菌对人工生长条件有特殊要求，在普通培养基上不生长，需添加L-半胱氨酸和铁盐（A对BCDE错）。